服用巴比妥类药物时，如果碱化尿液，则其在尿中
A. 解离度增高，重吸收减少，排泄加快
B. 解离度增高，重吸收增多，排泄减慢
C. 解离度降低，重吸收减少，排泄加快
D. 解离度降低，重吸收增多，排泄减慢
E. 排泄速度不改变

正确答案：A。解离度增高，重吸收减少，排泄加快

解析：本题考查药物的体内过程的有关内容。巴比妥类药物为弱酸性，在体液（pH7.4）中，有近50%或更多以分子型存在，能透过血脑屏障，到达中枢，因此具有活性。故碱化尿液，会增加药物的解离。服用时并给碳酸氢钠或乳酸钠碱化尿液，减少在肾小管中的重吸收，加速药物排泄（A对BCDE错）。